引起饮片质量变异自身因素有
A. 水
B. 油脂
C. 挥发油
D. 色素
E. 粘液

正确答案：A、B、C、D、E。水；油脂；挥发油；色素；粘液

解析：本题考查的是饮片质量变异的因素。引起饮片质量变异自身因素有水（A对）、油脂（B对）、挥发油（C对）、色素（D对）与黏液质（E对）。自身因素对中药质量变异的影响：1.水分；2.淀粉；3.黏液质；4.油脂；5.挥发油；6.色素；7.鞣质；8.无机化合物；9.树脂。